下列哪种病变引起的胸痛常沿一侧肋间神经分布
A. 胸肌劳损
B. 流行性胸痛
C. 颈椎病
D. 带状疱疹
E. 皮下蜂窝组织炎

正确答案：D。带状疱疹

解析：胸痛常沿一侧肋间神经分布的是带状疱疹（D对），带状疱疹可见沿神经分布的疱疹，疼痛呈刀割样、烧灼样，剧烈难忍，持续时间长。腰肌劳损（A错）表现为腰部酸痛或胀痛，部分表现为刺痛或灼痛。流行性胸痛（B错）表现为突发胸、腹部肌痛，疼痛轻重不一，呈刺痛、刀割样疼痛，咳嗽、翻身等加剧。颈椎病（C错）表现为颈背疼痛，上肢无力等症状。皮下蜂窝组织炎（E错）主要表现为局部出现红、肿、热、痛等症状。